由一个卡环臂和近缺隙侧的铸造（牙合）支托组成的卡环是
A. 锻丝卡环
B. 圈形卡环
C. 三臂卡环
D. 下返卡环
E. 单臂卡环

正确答案：B。圈形卡环

解析：圈形卡环：由一个卡环臂和近缺隙侧的铸造（牙合）支托组成。掌握“局部义齿固位体”知识点。